属于肿瘤特异性抗原的是
A. 癌胚抗原（CEA）
B. 胚性硫糖蛋白（FSA）
C. 甲基胆蒽诱发的肉瘤抗原
D. 甲胎蛋白（aFP）
E. 异型胎儿蛋白

正确答案：C。甲基胆蒽诱发的肉瘤抗原

解析：本题考查肿瘤特异性抗原。属于肿瘤特异性抗原的是甲基胆蒽诱发的肉瘤抗原（理化因素以及病毒诱生的肿瘤抗原多属于肿瘤特异性抗原）（C对）；癌胚抗原（CEA）（A错）、胚性硫糖蛋白（FSA）（B错）、甲胎蛋白（AFP）（D错）、异型胎儿蛋白（E错）均属于肿瘤相关抗原。